通过与物料接触的壁面传递热能，使物料中的水分气化而达到干燥目的的方法是
A. 对流干燥
B. 辐射干燥
C. 间歇式干燥
D. 传导干燥
E. 介电加热干燥

正确答案：D。传导干燥